属于选择性β₁受体阻断剂的抗高血压药物是
A. 拉贝洛尔
B. 阿罗洛尔
C. 卡维地洛
D. 普萘洛尔
E. 比索洛尔

正确答案：E。比索洛尔

解析：本题考查抗高血压药。属于选择性β₁受体阻断剂的抗高血压药物是比索洛尔（E对）。拉贝洛尔（A错）、阿罗洛尔（B错）、卡维地洛（C错）属于α₁和β受体阻断剂。普萘洛尔（D错）属于非选择性β受体阻断剂。